平滑面龋中，釉质晶体开始出现脱矿，晶体间孔隙较增大，用树胶可进入到孔隙中，属于平滑面龋的哪一层
A. 透明层
B. 暗层
C. 病损体层
D. 表层
E. 细菌侵入层

正确答案：A。透明层

解析：本题考查牙釉质龋。平滑面龋中，釉质晶体开始出现脱矿，晶体间孔隙较增大，用树胶可进入到孔隙中，属于平滑面龋的透明层（A对）。透明层位于病损的最前沿，和正常釉质相连，是龋损最早发生的组织学改变。此层釉质晶体开始出现脱矿，晶体间孔隙较正常釉质增大，孔隙容积约为1%，较正常釉质（0.1%）增多。当用加拿大树胶（折光率1.52）或喹啉（折光率1.62）作为介质封片时，这些大分子物质可进入到孔隙中，由于这些介质的折光率与正常釉质（折光率1.62）相似，故在光镜下观察，釉质的结构消失而呈透明状，与深层的正常釉质及透明层表层的暗层分界清楚。